移植器官超急排斥反应是由于
A. 供体内预存有抗受体的ABO血型抗体
B. 供体内预存有抗受体的HLAI类抗原的抗体
C. 受体内预存有抗供体的ABO血型抗体
D. 受体内有针对供体组织器官的Tc细胞
E. 供受者HLA配型不符

正确答案：C。受体内预存有抗供体的ABO血型抗体

解析：超急性排斥反应是由于受者体内预先存在抗供者组织抗原的抗体（AB错），包括供者ABO血型抗原（C对），血小板抗原，HLA抗原等，这些天然抗原多为IgM类。在血型相配的情况下，超急排多由IgG类抗体介导。Tc细胞即细胞毒性T细胞，能特异性杀伤带抗原的靶细胞，如移植细胞、肿瘤细胞及受微生物感染的细胞等，引起的排斥反应相对较慢，不会引起超级性排斥反应（D错）。超急性排斥反应属于宿主抗移植物反应，供受者HLA配型不符是引起移植物抗宿主反应的原因（E错）。